窝沟封闭的操作步骤包括
A. 酸蚀
B. 冲洗和干燥
C. 清洁牙面
D. 涂布封闭剂
E. 以上说法均正确

正确答案：E。以上说法均正确

解析：窝沟封闭的操作可分为清洁牙面、酸蚀、冲洗和干燥、涂布封闭剂、固化、检查六个步骤。掌握“窝沟封闭术”知识点。